关于狂犬病病毒的特点，哪项是错误的
A. 患病动物是传染源
B. 病毒只有一个血清型
C. 狂犬咬伤后100%发病
D. 可发生毒力变异
E. 可用病毒固定毒株制备疫苗进行预防

正确答案：C。狂犬咬伤后100%发病

解析：若人被犬等动物咬伤后，应立即清洗消毒伤口，使用高效价抗狂犬病病毒血清行伤口周围浸润注射及肌内注射，并将该动物捕获隔离观察，若经5～7日不发病，则一般认为该动物不是传染源。由于狂犬病的潜伏期较长，如及早应急接种狂犬病疫苗，于咬伤后第0、3、7、14、30日，各肌内注射1ml，可能预防发病。掌握“狂犬病、人乳头瘤病毒”知识点。